先兆早产的主要临床表现是
A. 规则宫缩60分钟内≥8次伴有宫颈管的进行性改变
B. 规则宫缩20分钟内≥4次伴有宫颈管的进行性改变
C. 宫颈扩张1cm以上
D. 不规则宫缩伴有宫颈管的进行性缩短
E. 宫颈展平≥80%

正确答案：D。不规则宫缩伴有宫颈管的进行性缩短

解析：（P59）早产临产符合下列条件：①出现规律宫缩（20分钟≥4次，或60分钟≥8次），伴有宫颈的进行性改变；②宫颈扩张1cm以上；③宫颈展平≥80%。但先兆早产的主要临床表现是有规则或不规则宫缩，伴有宫颈管的进行性缩短（D对AB错）。